下列不适于心理治疗的是
A. 神经症
B. 行为障碍
C. 心身疾病
D. 重症精神障碍的急性期
E. 某些慢性病患者的恢复期

正确答案：D。重症精神障碍的急性期

解析：心理治疗可广泛应用于临床与心理的许多疾病和问题。最常用于神经症、儿童与成人的行为障碍、应激或挫折后的情绪反应、重型精神病的恢复期、心身疾病的辅助治疗、学习问题、个性问题以及某些慢性病患者的康复治疗等。由于心理治疗具有自主性和学习性的性质，所以治疗应发生在患者意识清醒、自知力完好的状态下，故D不正确。掌握“心理治疗概述”知识点。